属于Ⅰc类的抗心律失常药物是
A. 奎尼丁
B. 利多卡因
C. 普罗帕酮
D. 胺碘酮
E. 维拉帕米

正确答案：C。普罗帕酮

解析：抗心律失常药分为四大类，Ⅰ类为钠通道阻滞药，Ⅱ类为β肾上腺素受体拮抗药，Ⅲ类为钾通道阻滞药，Ⅳ类为钙通道阻滞药。普罗帕酮（C对）是Ic类的抗心律失常药物，明显阻滞钠通道，减慢传导。奎尼丁（A错）（P193）是Ⅰa类，作用靶点多样，属于广谱抗心律失常药。利多卡因（B错）（P194）是Ⅰb类，主要治疗室性心律失常。胺碘酮（D错）（P194）是Ⅲ类（延长动作电位时程药），阻滞多种钾通道，是广谱抗心律失常药。维拉帕米（E错）（P194）是Ⅳ类（钙通道阻滞剂），主要抑制L型钙电流，减慢房室结传导，是阵发性室上性心动过速的首选药。